常见的心理评估方法不包括
A. 观察法
B. 调查法
C. 实验法
D. 会谈法
E. 测试法

正确答案：E。测试法

解析：本题考查心理评估的方法。常见的心理评估方法不包括测试法（E错，为本题的正确答案）。测试法不属于常见的心理评估方法。心理评估的常用方法包括：(1)调查法（B对）：是借助于各种问卷、调查表和晤谈等方式了解被评估者的心理特征的一种研究方法。(2)观察法（A对）：是心理学研究中最基本的方法，也是心理评估的基本方法之一。(3)会谈法（D对）：基本形式是评估者与被评估者面对面的谈话方式而进行的评估。(4)作品分析法：所谓作品是指被评估者在日常生活中创作的日记、书信、图画、手工艺品等，也包括生活和劳动中所做的事情和生产的其他物品。(5)心理测验法：是在实验心理学的基础上形成和发展起来的一种测量工具（C对）。